高渗性脱水时机体表现为
A. 细胞内液降低，细胞外液明显升高
B. 细胞内液明显降低，细胞外液降低
C. 细胞内液降低，细胞外液正常
D. 细胞内液明显升高，细胞外液明显降低
E. 细胞内液正常，细胞外液降低

正确答案：B。细胞内液明显降低，细胞外液降低

解析：高渗性脱水时失水多于失钠，细胞内液向渗透压相对高的外液转移，细胞内外液均降低（B对）。低渗性脱水时细胞外液渗透压降低，细胞外液的水分向渗透压相对高的细胞内液转移，使细胞内液升高，细胞外液进一步降低（D错）。